苓桂术甘汤与地西泮联用，可
A. 缩短疗程
B. 降低毒性
C. 减少用量
D. 协同增效
E. 改善体质

正确答案：C。减少用量

解析：本题考查的是中西药联用的特点。苓桂术甘汤与地西泮联用，可减少用量（C对）。地西泮有嗜睡等不良反应，若与苓桂术甘汤合用，地西泮用量只需常规用量的1/3，嗜睡等不良反应也因为并用中药而消除。降低毒性（B错）为六君子汤等与抗震颤麻痹药联用的效果。六君子汤等与抗震颤麻痹药联用，可减轻其胃肠道副作用，但也可能影响其吸收、代谢和排泄。协同增效（D错）木防己汤、真武汤、越婢加术汤、分消汤等与西药利尿药联用的效果。木防己汤、真武汤、越婢加术汤、分消汤等与西药利尿药联用，可以增强利尿效果。联用可缩短疗程（A错）或改善体质（E错）的中西药药组，2022年考试指南未明确说明。